再植牙成功的标准中，错误的是
A. 疼痛消失
B. 不松动
C. X线片示根无透射影
D. 行使功能达3年以上
E. 牙功能正常

正确答案：D。行使功能达3年以上

解析：本题考查再植牙成功的标准。再植牙成功的标准中，错误的是行使功能达3年以上（D错，为本题的正确答案）。牙再植成功的标准可类比口腔种植义齿成功标准：1.牙功能正常（E对）；2.麻木、疼痛消失（A对）；3.自我感觉良好；4.种植体周围X线片示根无透射影（C对），横行骨吸收不超过1/3，种植体不松动（B对）；5.龈炎可控制；6.无与种植体相关的感染；7.对邻牙支持组织无损害；8.美观；9.咀嚼效率达70%以上；10.符合上述要求者5年成功率应达到85%以上，10年80%以上。短期效果不足以证明种植成功，应通过行使功能达5年以上的成功率结合患者的临床表现来判断再植牙是否成功。